骨折后参与骨的修复
A. 骨质
B. 骺软骨
C. 骨膜
D. 骨髓
E. 关节软骨

正确答案：C。骨膜

解析：骨膜骨折后参与骨的修复（C对）。